属于肯氏一类二亚类的是
A. 缺失右下478，左下78
B. 缺失右下12458，左下1268
C. 缺失右下125678，左下124578
D. 缺失右下128，左下1356
E. 缺失右下1245，左下12

正确答案：C。缺失右下125678，左下124578

解析：本题考查肯氏分类。属于肯氏一类二亚类的是缺失右下125678，左下124578（C对）。1.肯氏分类：第一类：牙弓两侧后部牙缺失，远中无天然牙存在。第二类：牙弓一侧后部牙缺失，远中无天然牙存在。第三类：牙弓的一侧牙缺失，且缺隙两端均有天然牙存在。第四类：牙弓前部牙连续缺失并跨过中线，天然牙在缺隙的远中。2.对肯氏分类的归纳解释：第四类为单缺隙、无亚类，其余三类均按照除主要缺隙外的缺牙间隙数目作为亚类。即除主要缺隙外，如还有一个缺隙则为第一亚类，有两个缺隙则为第二亚类，依次类推。若前后都有缺牙，则以最后的缺牙间隙决定分类。若牙弓两侧后牙都有缺失，且一侧为远中游离端缺牙，另一侧为非游离端缺牙者，则以远中游离端缺牙间隙为基准，纳入第二类，另外缺隙数以亚类区别。若牙弓的最远端牙（如第三磨牙或第二磨牙）缺失但不修复，则不在分类之列；反之，这些缺失需考虑在分类之内。拔牙前不考虑分类，拔牙后才能进行分类。缺失右下478，左下78（A错）属于肯氏一类一亚类。缺失右下12458，左下1268（B错）属于肯氏一类三亚类。缺失右下128，左下1356（D错）属于肯氏二类三亚类。缺失右下1245，左下12（E错）属于肯氏三类一亚类。